生产注射剂时常加入适当活性炭，其作用是
A. 吸附热原
B. 增加主药的稳定性
C. 助滤
D. 脱盐
E. 提高澄明度

正确答案：A、C、E。吸附热原；助滤；提高澄明度

解析：本题考查注射剂常用的附加剂。活性炭是常用的吸附剂，用量一般为溶液体积的0.1%～0.5%。活性炭的吸附作用强，除了吸附热原（A对）外，还有脱色、助滤（CE对）作用。由于所加活性炭最终被滤除，故不能增加主药的稳定性（B错）。活性炭对盐类的吸附量小，达不到脱盐（D错）的效果。